某男，30岁。暴饮暴食后出现上腹部疼痛，伴恶心、呕吐、发热，检验结果显示血清淀粉酶活性显著增高，提示的疾病是
A. 急性肾炎
B. 急性胆囊炎
C. 急性心肌梗死
D. 急性胃肠炎
E. 急性胰腺炎

正确答案：E。急性胰腺炎

解析：本题考查淀粉酶（AMY）活性增高的临床意义。暴饮暴食后出现上腹部疼痛，伴恶心、呕吐、发热，检验结果显示血清淀粉酶活性显著增高，提示的疾病是急性胰腺炎（E对）。淀粉酶（AMY）临床意义：活性增高（1）诊断胰腺炎：①急性胰腺炎是AMY增高的最常见原因；②其他：慢性胰腺炎急性发作、胰腺囊肿、胰腺管阻塞时AMY也可升高。（2）胰腺癌早期AMY增高，是由于肿瘤压迫造成胰腺管阻塞和短时间内大量胰腺组织破坏所致。（3）其他：见于急腹症（病变累及胰腺）、乙醇中毒、肾衰竭（肾排泄AMY减少）。尿沉渣管型临床意义：1.急性肾小球肾炎（A错）：可见较多透明管型及颗粒管型，还可见红细胞管型。2.慢性肾小球肾炎：可见较多细、粗颗粒管型，也可见透明管型，偶见脂肪管型、蜡样管型和宽大管型。3.肾病综合征：常见有脂肪管型，容易见细、粗颗粒管型，也可见有透明管型。4.急性肾盂肾炎：可见少量白细胞管型，偶见有颗粒管型。5.慢性肾盂肾炎：可见较多白细胞管型、粗颗粒管型。血清丙氨酸氨基转移酶（ALT）临床意义：ALT增高的程度与肝细胞被破坏的程度呈正比，见于以下情况。1.肝胆疾病：传染性肝炎、中毒性肝炎、肝癌、肝硬化活动期、肝脓肿、脂肪肝、梗阻性黄疸、胆汁淤积或淤滞、胆管炎、胆囊炎（B错）。其中慢性肝炎、脂肪肝、肝硬化、肝癌者轻度上升或正常。2.其他疾病：急性心肌梗死（C错）（AMI）、心肌炎、心力衰竭所致的肝脏淤血、骨骼疾病、传染性单核细胞增多症、胰腺炎、外伤、严重烧伤、休克等。粪常规检查-粪外观：稀糊状或水样粪便常由肠蠕动亢进、水分吸收不充分所致，见于各种肠道感染性或非感染性腹泻，或急性胃肠炎（D错）；若出现大量的黄绿色稀便并含有膜状物则应考虑伪膜性肠炎症；大量水样便也可见于艾滋病患者的肠道孢子虫感染。